雄黄不具有的功效是
A. 解毒
B. 杀虫
C. 止血
D. 燥湿祛痰
E. 截疟定惊

正确答案：C。止血

解析：本题考查的是雄黄的功效。雄黄不具有的功效是止血（C错，为本题正确答案）。雄黄：【功效】解毒（A对），杀虫（B对），燥湿祛痰（D对），截疟定惊（E对）。止血为白矾的功效。白矾：【功效】外用解毒杀虫，燥湿止痒；内服止血止泻，清热消痰。